产科会阴是指
A. 系指尿生殖三角
B. 两耻骨下支之间的区域
C. 坐骨结节间的区域
D. 肛门与外生殖器之间的区域
E. 两坐骨棘之间的区域

正确答案：D。肛门与外生殖器之间的区域

解析：肛门与外生殖器之间的区域（D对）是产科会阴。广义的会阴将两侧坐骨结节的连线（C错）分为前方的尿生殖三角（A错）和后方的三角区肛门区，狭义会阴指外生殖器与肛门之间的区域（D错）。